慢性闭锁性牙髓炎的临床表现为，除外
A. 不定时的自发痛
B. 热测引起迟缓性疼痛
C. 洞内探及穿髓孔
D. 可有自发性疼痛史
E. 叩诊多有不适感

正确答案：C。洞内探及穿髓孔

解析：慢性闭锁性牙髓炎：龋洞深，探诊不敏感、未露髓；对冷、热诊不敏感或热测引起迟缓痛；叩诊（+）。掌握“可复性、急慢性牙髓炎”知识点。